下列不属于下颌第三磨牙阻生分类方法的是
A. 根据牙与下颌升支及第二磨牙的关系
B. 根据牙在骨内的深度
C. 根据牙龈覆盖阻生齿的程度
D. 根据阻生第三磨牙的长轴与第二磨牙的长轴关系
E. 可根据牙在正常牙列中线的位置

正确答案：C。根据牙龈覆盖阻生齿的程度

解析：本题考查阻生牙拔除术。根据牙龈覆盖阻生齿的程度（C错，为本题正确答案）不属于下颌第三磨牙阻生分类方法。下颌阻生牙（第三磨牙）的临床分类：根据牙与下颌升支及第二磨牙的关系（A对）、根据牙在骨内的深度（B对）、根据阻生第三磨牙的长轴与第二磨牙的长轴关系（D对），此外，还可根据牙在正常牙列中线的位置（E对）分为颊侧移位、舌侧移位及正中位三种。对于一个阻生的下颌第三磨牙的正确诊断描述，应包括以上各项。